成人器官移植中常发生GVHR的是
A. 骨髓移植
B. 肾移植
C. 心脏移植
D. 胸腺移植
E. 皮肤移植

正确答案：A。骨髓移植